心动周期的等容收缩期时
A. 心房压﹤心室压
B. 心房压﹥心室压
C. 主动脉压﹤心室压
D. 心房压﹥动脉压
E. 主动脉压＝心室压

正确答案：A。心房压﹤心室压